强心苷中毒心脏反应中最为严重的是
A. 室性心动过速
B. 室上性心动过速
C. 窦性心动过速
D. 室上性心律失常
E. 房室传导阻滞

正确答案：A。室性心动过速

解析：心脏毒性：为强心苷最严重的中毒反应，可引起多种类型的心律失常。①快速性心律失常可有室性早搏、二联率、三联律以及有异位节律点所致的房性、房室结性或室性心动过速，甚至发展为室颤，其中室性早搏及联律最常见且最早出现，约占心脏反应的33%，属中毒先兆，为停药指征。室性心动过速最为严重，应立即停药并抢救，以免发展为致死性的室颤（A对）。